腰痛患者，腰部冷痛重着，转侧不利，静卧痛不减，遇阴雨天疼痛加重，舌苔白腻，脉沉缓。其证候是
A. 寒湿
B. 风寒
C. 瘀血
D. 湿热
E. 肾虚

正确答案：A。寒湿

解析：患者“腰痛”，可诊断本病为腰痛病。腰痛病分寒湿腰痛、湿热腰痛、瘀血腰痛、肾虚腰痛（分肾阳虚、肾阴虚）四个证型。本题主要判断证属寒湿还是肾阳虚，两证都有腰部冷痛的表现。寒湿腰痛属实证，有湿证的表现，如酸胀重着，舌苔白腻，脉沉而缓；肾阳虚证属虚证，有阳虚的表现，如腰部隐痛，酸软无力，喜温喜按，遇劳更甚，卧则减轻等症。本题患者静卧痛不减，可判断为实证，遇阴雨天疼痛加重，舌苔白腻，脉沉缓，可判断为证属寒湿腰痛（A对）。